关于制洞的基本原则，下列哪一项是错误的
A. 尽量去净龋坏组织
B. 必须作倒凹
C. 必须注意保护牙髓
D. 必须制备抗力形和固位形

正确答案：B。必须作倒凹

解析：本题考查制洞的基本原则。侧壁固位良好的窝洞和（牙合）面Ⅰ类洞可不作倒凹；树脂充填时，其主要靠粘结固位，对洞形预备要求小亦可不作倒凹（B错，为本题的正确答案）。制洞的基本原则：1.必须去净龋坏组织（A对），防止激发龋的发生；2.必须注意保护牙髓 （C对），减少对牙髓的刺激；3.尽量保留健康牙体组织；4.必须制备抗力形和固位形（D对）。